患者，女。宫颈癌术后5天，突发下肢肿胀，伴胀痛。错误治疗措施
A. 卧床制动
B. 溶栓疗法
C. 应用止血药物
D. 抗凝疗法
E. 带弹力袜

正确答案：C。应用止血药物

解析：女性患者，宫颈癌术后5天（提示患者存在术后血液高凝状态、卧床使血流缓慢），突发下肢肿胀，伴胀痛（下肢深静脉血栓形成常表现为下肢突然发生的肿胀、伴有胀痛、浅静脉扩张、局部压痛明显、局部皮温及体温均升高）。综合患者病史及症状体征，初步诊断为：下肢深静脉血栓形成。此时应予卧床制动（A对）抬高患肢、带弹力袜（E对）以减轻患者肢体肿胀。溶栓疗法（B对）如静脉点滴链激酶、尿激酶、组织型纤溶酶原激活剂等，溶解血栓，有益于闭塞静脉的再通。抗凝治疗（D对），抗凝药物可降低机体血凝功能，预防血栓形成、防止血栓繁衍，有利于静脉再通。癌症患者血液呈高凝状态，手术后卧床使血流缓慢，应用止血药物（C错，为本题正确答案）会促进凝血块的形成，使患者病情加重。